病毒性脑膜炎与化脓性脑膜炎脑脊液检查相同的是
A. 氯化物减低
B. 蛋白质增高
C. 糖升高
D. 白细胞明显增高
E. 颅内压降低

正确答案：B。蛋白质增高

解析：小儿病毒性脑膜炎的脑脊液外观清亮，个别微浊，压力不同程度增高，白细胞总数正常至数百，淋巴细胞为主，糖含量正常，蛋白质含量正常或轻度增高；小儿化脓性脑膜炎的脑脊液外观混浊，压力增高，白细胞总数显著增多，达1000×10⁶/L，分类以中性粒细胞为主，糖含量明显降低，常<1.1mmol/L，蛋白质含量增高，多>1g/L，故白细胞明显增高是两者的相同之处（B对）。两者压力均升高（E错）。